简化口腔卫生指数（OHI-S）需检查牙面数为
A. 4个牙面
B. 6个牙面
C. 4个舌面
D. 6个舌面
E. 2个唇（颊）面

正确答案：B。6个牙面

解析：简化口腔卫生指数（OHI-S）是Greene和Vermillion对他们在1964年提出的，它只检查6个牙面16、11、26、31的唇（颊）面，36、46的舌面。掌握“牙周病流行病学及分级预防”知识点。